在土壤中残留时间最长从而易造成危害的农药是
A. 有机磷
B. 有机氯
C. 拟除虫菊酯类
D. 氨基甲酸酯类
E. 杀菌剂

正确答案：B。有机氯

解析：本题考查在土壤中残留时间最长从而易造成危害的农药。有机氯农药（B对ACDE错）是组成成分中含有氯元素的有机化合物，是最早使用的化学合成农药，在土壤中残留时间最长从而易造成危害。